某男，63岁。平素肌肤不仁，手足麻木；2天前，晨起突发口眼㖞斜，语言不利，口角流涎，右侧肢体活动受限，关节酸痛；舌苔薄白，脉浮数。医师诊断为中风，治以祛风化痰通络，处方如下：制白附子6g，法半夏9g，蜈蚣3g，天麻9g，制天南星9g，枳壳9g，木香6g，全蝎9g，制川乌（先煎）3g；3剂，水煎服，每日1剂，早晚分服。根据《中国药典》，处方中用量超出每日剂量的饮片是
A. 制天南星
B. 制川乌
C. 制白附子
D. 蜈蚣
E. 全蝎

正确答案：E。全蝎

解析：本题考查毒性药材和饮片的用法用量。用量错误的是全蝎（E错，为本题正确答案）。中风之风痰入络证【症状】肌肤不仁，手足麻木，突然发生口眼㖞斜，语言不利，口角流涎，舌强语謇，甚则半身不遂，或兼见手足拘挛，关节酸痛等症。舌苔薄白，脉浮数。【治法】祛风化痰通络。【方剂应用】基础方剂真方白丸子（半夏、白附子、天南星、天麻、川乌、全蝎、木香、枳壳）加减。剂量建议：方中半夏、白附子、天南星、川乌、全蝎均有毒，不建议长期大量使用。《药典》规定法半夏用量不超过9g，制白附子（C对）用量不超过6g，制天南星（A对）用量不超过9g，制川乌（B对）用量不超过3g，全蝎用量不超过6g。